以动物某一部分的加工品入药的药材有
A. 阿胶
B. 鹿角霜
C. 血余炭
D. 僵蚕
E. 龟甲胶

正确答案：A、B、C、E。阿胶；鹿角霜；血余炭；龟甲胶

解析：本题考查的是用药部位为动物体某一部分的加工品。以动物某一部分的加工品入药的药材有阿胶（A对）、鹿角霜（B对）、血余炭（C对）或龟甲胶（E对）。常用动物类中药的药用部位：1.动物的干燥整体，如水蛭、全蝎、蜈蚣、斑蝥、土鳖虫、虻虫、九香虫等。2.除去内脏的动物体，如地龙、蛤蚧、乌梢蛇、蕲蛇、金钱白花蛇等。3.动物体的某一部分，角类：如鹿茸、鹿角、羚羊角、水牛角等；鳞、甲类：如龟甲、鳖甲等；骨类：如豹骨、狗骨、猴骨等；贝壳类：如石决明、牡蛎、珍珠母、海螵蛸、蛤壳、瓦楞子等；脏器类：如蛤蟆油、鸡内金、鹿鞭、海狗肾、水濑肝、刺猾皮等。4.动物的生理产物，分泌物：如麝香、蟾酥、熊胆粉、虫白蜡、蜂蜡等；排泄物：如五灵脂、蚕砂、夜明砂等；其他生理产物：如蝉蜕、蛇蜕、蜂蜜、蜂房等。5.动物的病理产物，如珍珠、僵蚕（D错）、牛黄、马宝、猴枣、狗宝等。6.动物体某一部分的加工品，如阿胶、鹿角胶、鹿角霜、龟甲胶、血余炭、水牛角浓缩粉等。